中毒后临床表现为双侧曈孔散大的毒物是
A. 有机磷杀虫剂
B. 氯丙嗪
C. 阿片类药物
D. 吗啡
E. 阿托品

正确答案：E。阿托品

解析：阿托品抑制副交感，造成拟交感兴奋效果，我们可以通过记忆交感神经的作用效果来反推阿托品的效果，或者记忆阿托品（E对）通常用于眼部检查时的散瞳药。阿托品通常用于拮抗有机磷杀虫剂所导致的瞳孔缩小，毒蕈碱样症状（A错）。精神类药物如阿片类（CD错），常出现三联征，昏迷，呼吸抑制和瞳孔缩小。